阿片类镇痛药与阿托品合用，可抑制胃肠蠕动，导致的不良反应是
A. 胆绞痛
B. 低血压
C. 便秘
D. 躁狂
E. 多汗

正确答案：C。便秘

解析：本题考查药物的相互作用。阿片类镇痛药与阿托品合用，可抑制胃肠蠕动，导致便秘（C对）。阿片类镇痛药可激动阿片受体，其中μ₂受体激动可引起胃肠道运动抑制，同时阿托品剂量增加可使胃肠道平滑肌兴奋性降低，所以两者合用可增强抑制胃肠蠕动的作用，导致便秘。